患者，男，5岁。腹痛绕脐，多食善饥，面黄肌瘦，大便排出蛔虫宜首选的药物是
A. 使君子
B. 榧子
C. 雷丸
D. 芒硝
E. 贯众

正确答案：A。使君子

解析：患者腹痛绕脐，多食善饥，面黄肌瘦，有蛔虫，应首选使君子。使君子功效既能杀虫又能健脾消疳，为治疗小儿蛔虫病要药。可用于治疗蛔虫病，蛲虫病，虫积腹痛；小儿疳积（A对）。榧子的功效为杀虫消积，润肺止咳，润燥通便。治疗钩虫病，蛔虫病，绦虫病，虫积腹痛；小儿疳积；肺燥咳嗽；肠燥便秘（B错）。雷丸的功效为杀虫消积。治疗绦虫病，钩虫病，蛔虫病，虫积腹痛；小儿疳积（C错）。芒硝的功效为泻下通便，润燥软坚，清火消肿。治疗实热积滞，腹满胀痛，大便燥结；肠痈腹痛；乳痈，痔疮肿痛，咽痛口疮，目赤肿痛（D错）。贯众的功效为清热解毒，驱虫，止血。治疗时疫感冒，风热头痛，温毒发斑；痄腮，疮疡肿毒；虫积腹痛；崩漏下血（E错）。